关于ACE1制剂治疗慢性心功能不全的作用，错误的是
A. 抑制心肌重构
B. 改善心肌的顺应性
C. 收缩冠脉，改善心肌缺血缺氧
D. 逆转心室肥厚
E. 改善心舒张功能

正确答案：C。收缩冠脉，改善心肌缺血缺氧

解析：ACEI能防止和逆转高血压患者心肌和血管壁的重构（A对），改善心肌和动脉顺应性（B对），改善心舒张功能（E对），提高患者生活质量和降低死亡率；该类药物可减少缓激肽降解，进而通过后者刺激NO、cGMP、血管活性前列腺素的产生，而发挥扩张血管等作用（C错，为本题正确答案）。ACE抑制药抑制心脏的重构和肥厚（D对）是其降低CHF病死率的重要原因。